溃疡性结肠炎最常见的病变部位是
A. 横结肠
B. 降结肠
C. 回盲部
D. 直肠及乙状结肠
E. 升结肠

正确答案：D。直肠及乙状结肠

解析：溃疡性结肠炎病变多发生在直肠及乙状结肠（D对），也可累及全结肠甚至末段回肠。横结肠（A错）是溃疡性结肠炎并发中毒性巨结肠的好发部位（P374）。回盲部（C错）为肠结核的好发部位（P368）。升结肠（E错）是阿米巴肠病的好发部位。